固定桥粘固后短时间内出现咬合时疼痛，首先要检查的是
A. 根尖状况
B. 咬合状况
C. 牙龈状况
D. 牙槽骨状况
E. 缺牙区牙槽嵴黏膜

正确答案：B。咬合状况

解析：固定桥粘固后短期内出现咬合疼痛，多为早接触点引起的创伤性牙周膜炎，经过调（牙合）处理后，疼痛会很快消失。若未及时调（牙合），有时会因创伤而引起急性牙周膜炎，疼痛加剧，必要时需在局麻下拆除固定桥，待痊愈后重做。所以固定桥粘固后短期疼痛应首先检查的是咬合情况。掌握“固定桥修复后出现的问题及处理”知识点。